原发性肝癌的肝外血行转移最多见于
A. 肺
B. 骨
C. 脑
D. 脾
E. 胰

正确答案：A。肺

解析：原发性肝癌癌细胞进入血液，回流至右心，经过肺循环进入肺，瘀滞并停留于肺毛细血管内，在局部生长形成转移灶，其肝外血行转移最多见于肺（A对）。骨（B错）、脑（C错）、脾（D错）、胰（E错）转移较少见。